将以下数字修约为四位有效数字：0.15605
A. 1.560×10³
B. 10560×10³
C. 1.56
D. 0.1561
E. 0.156

正确答案：E。0.156